3岁女孩，反复咳嗽2个月，查体：体温正常，浅表淋巴结（-），咽（-），两肺多哮鸣音，无水泡音，反复抗生素治疗不愈，以往无呛咳病史，有过敏性鼻炎。首选的检查是
A. 胸片
B. 气管镜
C. 血培养
D. 气道分泌物病毒分离
E. 心电图

正确答案：A。胸片

解析：3岁女孩，反复咳嗽2个月，查体：体温正常，浅表淋巴结（-），咽（-），两肺多哮鸣音，无水泡音，反复抗生素治疗不愈，以往无呛咳病史，有过敏性鼻炎等表现符合咳嗽变异型哮喘的诊断标准，故首选的检查是胸片（A对），因为胸部X线检查不但可显示肺部病变，还可排除肺部其他疾病，如肺炎、肺结核、气管支气管异物和先天性呼吸系统畸形等。而气管镜（B错）主要用于肺癌、肺不张、不明原因咯血等诊断。血培养（C错）主要用于感染性疾病分离培养致病菌。气道分泌物病毒分离（D错）主要用于呼吸系统病毒感染时分离病毒。心电图（E错）主要用于诊断心律失常等疾病。